以下哪一项不属于酸蚀的作用
A. 增加釉质表面的粘结面积
B. 增大釉质表面可湿性有利于粘接剂的渗入
C. 保护牙髓活力
D. 暴露出釉质新鲜层
E. 增加釉质表面的粗糙度

正确答案：C。保护牙髓活力

解析：酸蚀的作用包括：①酸溶解釉质表面的羟磷灰石，暴露出釉质新鲜层，增大釉质表面可湿性和表面自由能，有利于粘接剂的渗入；②酸蚀还可以活化釉质表层，经酸处理后，釉质表面的极性增强，易与粘接树脂结合；③酸蚀增加釉质表面的粘结面积和粗糙度。掌握“树脂粘结概念及釉质、牙本质粘结”知识点。